代谢酶的单功能诱导剂发挥作用是通过
A. AhR结合
B. CAR结合
C. PXR结合
D. Nrf2结合
E. PPARα结合

正确答案：D。Nrf2结合